慢性肾衰竭失代偿期是指GFR（肾小球滤过率）的范围是
A. ＜25ml/分
B. 25～50ml/分
C. 50～60ml/分
D. 60～70ml/分
E. 70～80ml/分

正确答案：B。25～50ml/分

解析：临床常用Ccr（血肌酐清除率）代替GFR，Ccr为80～50ml/min为代偿期（CDE错）。Ccr为50～20ml/min为失代偿期（B对）。Ccr为19～10ml/min为肾衰竭期（A错）。Ccr＜10ml/min为尿毒症期或终末肾衰竭期。